女性，17岁。确诊爆发型流行性脑脊髓膜炎。应首选下列哪种药物治疗
A. 磺胺嘧啶（SD）
B. 青霉素G
C. 头孢氨苄
D. 头孢呋辛
E. 复方新诺明

正确答案：B。青霉素G

解析：本题考查流行性脑脊髓膜炎的治疗。女性，17岁。确诊爆发型流行性脑脊髓膜炎，病原菌为脑膜炎奈瑟菌，革兰阴性，首选治疗药物为青霉素G（B对）。磺胺嘧啶（SD）（A错）可用于流行期间儿童口服预防。头孢氨苄（C错）属于第一代头孢菌素，对G⁺菌作用较强，但对G⁻的作用差，主要用于治疗敏感菌所致呼吸道和尿路感染、皮肤及软组织感染。头孢呋辛（D错）属于第二代头孢菌素，对G⁻有明显作用，可用于治疗敏感菌所致肺炎、胆道感染、菌血症、尿路感染和其他组织器官感染等。复方新诺明（E错）属于磺胺药物，可用于流行期间儿童口服预防。